固有心房与腔静脉窦的表面分界是
A. 界沟
B. 界嵴
C. 房室交点
D. 房间沟
E. 心尖切迹

正确答案：A。界沟

解析：界沟（A对）为固有心房与腔静脉窦的表面分界，前部为固有心房，后部为腔静脉窦。